对乙酰氨基酚的毒性代谢物是
A. 对氨基酚
B. N-乙酰基亚胺醌
C. 对乙酰氨基酚硫酸酯
D. 对乙酰氨基酚葡萄糖醛酸结合物
E. 对苯二酚

正确答案：B。N-乙酰基亚胺醌

解析：本题考查对乙酰氨基酚的代谢物。N-乙酰基亚胺醌（B对）是对乙酰氨基酚的毒性代谢产物。在正常情况下，N-乙酰基亚胺醌可与肝内的谷胱甘肽结合而解毒。若应用本品过量时，因谷胱甘肽被耗尽，代谢物即与肝蛋白结合，引起肝组织坏死。对氨基酚（A错）毒性较大，是合成过程中乙酰化不完全或贮藏过程中水解引入的杂质，非代谢产物。